女，50岁。月经周期紊乱两年，现停经40天，基础体温单相，宫颈粘液羊齿状结晶呈高度影响，此时下列何项为相应的子宫内膜表现
A. 增生期图像
B. 分泌期图像
C. 萎缩图像
D. 分泌早期图像
E. 增生过长图像

正确答案：E。增生过长图像

解析：本例诊断为更年期功血。基础体温单相表明无排卵，故子宫内膜无分泌期变化，宫颈粘液羊齿状结晶呈高度影响表明受雌激素高度影响，故子宫内膜会出现增生过长的表现。掌握“功能失调性子宫出血”知识点。